降低肺结核传染最主要的措施是
A. 合理处理肺结核患者痰液
B. 减少接触排菌者的密切程度
C. 高危人群预防性化学治疗
D. 治愈涂阳肺结核患者
E. 接种卡介苗

正确答案：D。治愈涂阳肺结核患者

解析：结核病在人群中的传染源主要是结核病患者，即痰直接涂片阳性者。降低肺结核传染最主要的措施是治愈涂阳肺结核患者（D对）。合理处理肺结核患者痰液（A错）、减少接触排菌者的密切程度（B错）、高危人群预防性化学治疗（C错）、接种卡介苗（E错）都属于预防结核病发生的措施。